患者，女，18岁，两小腿皮肤炎症在急性阶段，大量渗液且红肿。外治剂宜用
A. 洗剂
B. 粉剂
C. 溶液湿敷
D. 油剂
E. 软膏

正确答案：C。溶液湿敷

解析：洗剂有清凉止痒、保护、干燥的作用，适用于无渗出性的急性或亚急性的皮肤病（A错）。粉剂有保护、吸收、蒸发、干燥、止痒的作用，适用于无渗出的急性或亚急性皮肤病，也适用于溃疡、窦道腐肉未脱者（B错）。溶液湿敷适用于急性皮肤病，红肿明显、渗出较多或脓性分泌物多的皮损，或糜烂伴轻度痂皮性损害，题中患者大量渗液并红肿，故（C对）。油剂具有润泽保护、清洁去痂、收敛生肌的作用，适用于亚急性皮肤病有少量糜烂渗出、结痂、溃疡的皮损（D错）。软膏有保护疮面，润滑皮肤，清除痂皮，软化角质，促进吸收的作用（E错）。